男，44岁。大量饮酒后出现上腹部剧烈疼痛，伴呕吐，呕吐后腹痛不缓解。保守治疗2天，病情持续恶化，并出现休克。查体：T38.9℃，脐周及背部可见大片青紫瘀斑，上腹腹肌紧张，压痛反跳痛明显，肠鸣音减弱。最重要的治疗措施是
A. 抗休克治疗
B. 急诊治疗
C. 择期手术
D. 纠正休克后急诊手术
E. 应用广谱抗生素

正确答案：D。纠正休克后急诊手术

解析：青年男性患者，大量饮酒后（急性胰腺炎的常见病因）出现上腹部剧烈疼痛，伴呕吐，呕吐后腹痛不缓解（急性胰腺炎的典型临床表现）。保守治疗2天，病情持续恶化，并出现休克（提示病情危重）。查体：T38.9℃，脐周及背部可见大片青紫瘀斑（Cullen征及Grey-Turner征，提示为重症急性胰腺炎），上腹腹肌紧张，压痛反跳痛明显（典型的腹膜刺激征表现），肠鸣音减弱（提示存在肠麻痹）。综合该患者的病史及体查，应诊断为重症急性胰腺炎。重症急性胰腺炎患者，保守治疗2天无效，病情恶化，出现高热及休克表现，需考虑胰腺和胰周组织坏死继发感染，最重要的治疗措施纠正休克后急诊手术（D对），手术方式以坏死组织清除术和局部灌洗引流为主。感染性休克行单纯的抗休克治疗（A错）而不处理感染灶，难以稳定血压。患者已出现休克，一般情况差，急诊手术治疗（B错）风险较大。患者病情危重，须及时处理，择期手术（C错）延误治疗时机。胰腺和胰周坏死组织继发感染，单纯应用广谱抗生素（E错）效果欠佳，仅作为辅助治疗措施。